戴某，男，8岁，2个月来，左上后牙食物嵌塞，冷热刺激疼痛。无自发痛史，未经治疗。检查：咬合面龋洞内有大量软龋，探（++），叩（-），未穿髓。X线示深龋近髓，根尖未完全形成。首先应考虑的治疗方法是
A. 根管治疗
B. 根尖诱导成形术
C. 盖髓治疗
D. 深龋再矿化治疗
E. 活髓切断术

正确答案：D。深龋再矿化治疗

解析：本题考查年轻恒牙龋病的治疗。由于氢氧化钙的pH值在11以上，有一定的杀菌作用，可以抑制龋蚀的进展，且其刺激作用促使牙髓形成修复性牙本质，并使大量的钙和磷自牙髓进入脱矿牙本质，若全部去除龋蚀牙本质可能会露髓的病例，可采用深龋再矿化治疗（D对），即首次在去除龋蚀后，于洞底盖上氢氧化钙糊剂，用氧化锌丁香油黏固剂垫底，磷酸锌黏固剂充填，10～12周后再次治疗，去除充填物，作间接盖髓、垫底及永久性修复。因患儿患牙深龋露髓，根尖未完全形成，属于年轻恒牙，为使牙根继续发育，需保留牙髓，故不应进行根管治疗（A错）。根尖诱导成形术（B错）适用于牙髓病已波及根髓而不能保留或不能全部保留根髓的年轻恒牙，也适用于牙髓全部坏死或并发根尖周炎症的年轻恒牙。盖髓治疗（C错）需去除龋洞内大量的软化牙本质，容易造成该患牙露髓。活髓切断术（E错）是除去病变的冠髓，保留健康根髓的治疗方法，患牙无自发痛，可能处于可复性牙髓炎阶段，故无需进行切髓。